β受体阻断药
A. 可使心率加快、心排出量增加
B. 有时可诱发或加重哮喘发作
C. 促进脂肪分解
D. 促进肾素分泌
E. 升高眼压

正确答案：B。有时可诱发或加重哮喘发作